在感染根管治疗过程中，常在封入某种药物后数分钟到数小时突然暴发疼痛现象，可能是由于
A. 根尖暴发感染急性发作
B. 根管器械对根尖周组织损伤
C. 根管器械将细菌推入根尖周引发急性感染
D. 封入的药物作为半抗原引发急性免疫变态反应
E. 残留牙髓发生牙髓炎

正确答案：D。封入的药物作为半抗原引发急性免疫变态反应

解析：本题考查宿主对细菌感染的反应-免疫反应。许多根管治疗药物具有抗原性，可以引起变态反应，导致疼痛；在感染根管治疗过程中，常在封入某种药物后数分钟到数小时突然暴发疼痛现象，可能是由于封入的药物作为半抗原引发急性免疫变态反应（D对）而引起的。